前置胎盘的正确处理是
A. 有阴道出血，即终止妊娠
B. 分娩方式，宫口开，剖腹产
C. 胎儿死亡，均以阴道分娩
D. 疑有前置胎盘，肛诊时宜轻柔
E. 大出血时，可不经阴道检查，做剖宫产

正确答案：E。大出血时，可不经阴道检查，做剖宫产

解析：完全性前置胎盘必须以剖宫产结束分娩，部分性或初产妇边缘性前置胎盘，近年也倾向行剖宫产。掌握“前置胎盘”知识点。